男性，42岁。3天来右上后磨牙痛重，冷热加剧，夜间痛而来就诊。近1年多来，右上磨牙进食时咬到某特定位置时出现撕裂样痛，冷热敏感，平时咬物不适。检查：16咬合面似有近远中方向越过边缘嵴的细裂纹，颊尖高陡，无龋洞，不松动，叩痛（+）。该患牙疾病的病因是
A. 细菌因素
B. 物理因素
C. 化学因素
D. 发育异常
E. 遗传因素

正确答案：B。物理因素

解析：本题考查隐裂。根据题干可知本病是牙隐裂引起的急性牙髓炎，牙隐裂的病因多由于咬合力过大引起的，为物理因素（B对）。